腹前壁脐平面以下的浅淋巴直接注入
A. 髂外淋巴结
B. 髂总淋巴结
C. 髂内淋巴结
D. 腹股沟浅淋巴结
E. 腹股沟深淋巴结

正确答案：D。腹股沟浅淋巴结

解析：脐平面以下浅淋巴直接注入腹股沟浅淋巴结（D对），深淋巴结注入腹股沟深淋巴结（E错）、髂外淋巴结（A错）和腰淋巴结。